马勃的功效是
A. 利咽，凉血
B. 利咽，祛痰
C. 利咽，通便
D. 利咽，止血
E. 利咽，疏肝

正确答案：D。利咽，止血

解析：本题考查的是马勃的功效。马勃的功效是利咽，止血（D对）。马勃：【功效】清肺，解毒，利咽，止血。板蓝根：【功效】清热解毒，凉血，利咽（A错）。射干：【功效】清热解毒，祛痰利咽（B错），散结消肿。胖大海：【功效】清宣肺气，清肠通便。胖大海甘寒，功能清宣肺气、利咽（C错）开音。木蝴蝶：【功效】清热利咽，疏肝（E错）和胃。